职业肿瘤的发病条件包括
A. 致癌物的性质
B. 接触途径
C. 剂量
D. 机体对致癌物的敏感性
E. 以上全是

正确答案：E。以上全是

解析：本题考查职业肿瘤的致癌条件。大量动物实验和流行病学调查研究证明，多数致癌物都明显存在剂量-反应关系，即暴露于同一致癌物总剂量（累加上通过非职业途径接触剂量）较大的人群比接触剂量小的人群肿瘤发病率和死亡率都高。职业性致癌因素种类不同，各自导致的职业性肿瘤具有不同的特定病理类型。职业性肿瘤要在一定条件下才能发生，主要与职业性致癌因素的理化特性强度作用方式等有关。职业性肿瘤是否发生还与接触者的健康状况、个体易感性、行为与生活方式等有关（E对ABCD错）。